治疗亡阳证，寒饮喘咳，应首选的药物是
A. 附子
B. 干姜
C. 肉桂
D. 吴茱萸
E. 小茴香

正确答案：B。干姜

解析：本题考查干姜的功效、应用。干姜具有温中散寒，回阳通脉，温肺化饮的功效。可用于腹痛，呕吐，泄泻；亡阳证；.寒饮喘咳（B对）。附子具有回阳救逆，补火助阳，散寒止痛的功效，可用于亡阳证；阳虚；寒痹证（A错）。肉桂具有补火助阳，散寒止痛，温经通脉，引火归原的功效，可用于阳痿，宫冷；腹痛，寒疝；腰痛，胸痹，阴疽，闭经，痛经；虚阳上浮（C错）。吴茱萸具有散寒止痛，降逆止呕，助阳止泻的功效，可用于寒凝疼痛；胃寒呕吐；虚寒泄泻（D错）。小茴香具有散寒止痛，理气和胃的功效，可用于寒疝腹痛，睾丸偏坠胀痛，少腹冷痛，痛经；中焦虚寒气滞证（E错）。